以下哪一项不是更年期综合征的主要临床表现
A. 腰背痛
B. 易骨折
C. 潮红、潮热
D. 血压波动
E. 蚁行感

正确答案：B。易骨折

解析：本题考查更年期综合征的主要临床表现。易骨折（B错，为本题正确答案）不属于更年期综合征的主要临床表现。更年期综合征的主要临床表现包括（1）血管舒缩失调症状：①潮红、潮热（C对）和出汗；②高血压：以收缩压升高为主，具有明显波动性（D对）；③假性心绞痛。（2）神经心理症状：易激动、急躁、焦虑、抑郁、失眠、记忆力减退、注意力不集中、皮肤刺痒、麻木或蚁行感（E对）。（3）一般症状：①肌肉、关节痛：常在受寒、受累时出现肩、颈、腰背部痛（A对）；②泌尿生殖系统症状：尿频、尿痛、排尿困难、阴道干燥及烧灼感、性交痛及性交困难等；③代谢改变引起的症状：面部及双下肢水肿和单纯性肥胖，尿糖和血糖增高等。